红细胞血型所涉及的特异物质类型是
A. 红细胞膜上凝集素
B. 红细胞膜上凝集原
C. 红细胞膜上受体
D. 血浆中凝集素
E. 血浆中凝集原

正确答案：B。红细胞膜上凝集原

解析：血型通常是指红细胞膜上特异性抗原的类型，因红细胞膜上特异性抗原在凝集反应中被称为凝集原，因此通常所说的血型是指红细胞膜上凝集原的类型（B对）；能与红细胞膜上的凝集原起反应的特异性抗体则称为凝集素（AD错），主要存在于血浆中。